对β₁受体激动作用强于β₂受体的药物是
A. 肾上腺素
B. 多巴酚丁胺
C. 沙丁醇胺
D. 可乐定
E. 麻黄碱

正确答案：B。多巴酚丁胺